哪种方法是任何方法无法取代的
A. 会谈法
B. 观察法
C. 作品分析法
D. 心理测验法
E. 调查法

正确答案：D。心理测验法

解析：心理测验法：在心理评估中，心理测验占有十分重要的地位。尽管一些基本方法（会谈法、调查法、观察法）应用普遍，但是这些都无法取代心理测验的作用。掌握“心理评估概述”知识点。